急进性肾小球肾炎Ⅰ型患者血液浓度常升高的抗体是
A. 抗肾小球基底膜抗体
B. 抗核抗体
C. 抗双链DNA抗体
D. 抗中性粒细胞胞浆抗体
E. 抗平滑肌抗体

正确答案：A。抗肾小球基底膜抗体

解析：Ⅰ型急进性肾小球肾炎又称为抗肾小球基底膜（GBM）型肾小球肾炎，是由于抗GBM抗体与GBM抗原相结合激活补体而致病，因此急进性肾小球肾炎Ⅰ型患者血液浓度常升高的抗体是抗肾小球基底膜抗体（A对）。抗核抗体（B错）、抗双链DNA抗体（C错）主要见于系统性红斑狼疮（P817）。抗中性粒细胞胞浆抗体（D错）主要见于快速进行性血管炎肾炎（九版诊断学P430）。抗平滑肌抗体（E错）主要用于见于自身免疫性肝炎、原发性胆汁性肝硬化、急性病毒性肝炎（九版诊断学P429）。